男性，25岁。因高位小肠瘘1天入院，入院后经颈内静脉插管滴入肠外营养液，两周后突然出现寒战、高热，无咳嗽、咳痰，腹部无压痛和反跳痛。最有可能的诊断是
A. 高渗性非酮症昏迷
B. 肺部感染
C. 气胸
D. 导管性脓毒症
E. 咽喉部感染

正确答案：D。导管性脓毒症

解析：患者因肠瘘而行肠外营养，后出现寒战、高热等全身感染症状，而无咳嗽、咳痰，故其最有可能的诊断为导管性脓毒症（D对）。导管性脓毒症是指肠外营养时，由于长期中心静脉导管置入而引发的严重感染，常表现为寒战、高热、恶心、呕吐等全身性症状。高渗性非酮症昏迷（A错）发生在糖尿病患者，主要表现为高血糖、高渗透压、脱水、昏迷或意识障碍。肺部感染（B错）、咽喉部感染（E错）常有咳嗽、咳痰。气胸（C错）主要表现为突发的胸闷和呼吸困难。